在药品命名中，国际非专利药品名称是
A. 商品名
B. 通用名
C. 化学名
D. 别名
E. 药品代码

正确答案：B。通用名

解析：本题考查药物的名称。药品通用名（B对）也称为国际非专利药品名称（INN），是世界卫生组织（WHO）推荐使用的名称，通常是指有活性的药物物质，而不是最终的药品，因此是药学研究人员和医务人员使用的共同名称。药品的商品名（A错）是由制药企业自己进行选择的，它和商标一样可以进行注册和申请专利保护。化学名（C错）是根据药品的化学成分确定的化学学术名称。药物的名称包括药物的通用名，化学名和商品名，别名（D错）、药品代码（E错）不属于药物的名称。